可以引起急性上呼吸道感染的病毒微生物不包括
A. 鼻病毒
B. 呼吸道合胞病毒
C. 流感病毒
D. 腺病毒
E. 肺炎链球菌

正确答案：E。肺炎链球菌

解析：各种病毒和细菌均可以引起急性上呼吸道感染，但90%以上为病毒，主要有鼻病毒、呼吸道合胞病毒、流感病毒、副流感病毒、腺病毒、柯萨奇病毒、冠状病毒等。掌握“急性上呼吸道感染”知识点。